全身用药抗炎作用最强，作用持续时间最长的糖皮质激素是
A. 米托坦
B. 地塞米松
C. 可的松
D. 氯轻松
E. 甲泼尼松

正确答案：B。地塞米松